关于缺血性脑血管病防治的说法，错误的是
A. 二级预防指疾病发生后预防复发的措施
B. 通过控制血压、血脂、血糖，能有效降低复发风险
C. 积极治疗伴发疾病，如冠心病、阻塞性睡眠呼吸暂停综合征等
D. 对短暂性脑缺血发作（TIA）患者应给予抗凝药物进行卒中一级预防
E. 缺血性脑卒中发病后3小时内溶栓，可避免或减轻脑卒中后遗症

正确答案：D。对短暂性脑缺血发作（TIA）患者应给予抗凝药物进行卒中一级预防

解析：本题考查缺血性脑血管病防治。对短暂性脑缺血发作（TIA）患者应给予抗凝药物进行二级预防（D错，为本题正确答案）。脑血管疾病的三级预防：（1）一级预防：系指发病前的预防。（2）二级预防：是指疾病发生后预防复发的措施（A对）。（3）三级预防：对已出现脑卒中的病人进行干预防止并发症，减轻残疾程度，提高病人的生活质量，预防复发。积极控制可预防的危险因素如高血压、血脂异常、糖尿病、阻塞性睡眠呼吸暂停低通气综合征（C对）、高同型半胱氨酸血症等，以减少脑血管病的发生或复发（B对）。缺血性脑卒中发病后3小时内溶栓，可避免或减轻脑卒中后遗症（E对）。